患者，女，33岁。结喉右侧可及3cm×3cm×3cm肿物，表面光滑，质韧，无压痛，随吞咽上下移动。应首先考虑的
A. 气瘿
B. 肉瘿
C. 血瘿
D. 石瘿
E. 瘿痈

正确答案：B。肉瘿

解析：肉瘿多见于30～40岁，以女性占多数，在结喉正中一侧或双侧有单个肿块，呈半圆形，表面光滑，可随吞咽动作上下移动，按之不痛，生长缓慢，一般无明显全身症状，本病例发病年龄及肿块特点与之相符，故诊断肉瘿（B对）。气瘿，临床特点为颈部甲状腺腺体弥漫性肿大，边缘不清，随喜怒消长，皮色如常，质软无压痛，随吞咽动作上下移动，女性发病率较男性略高，一般多发生在青春期，虽然气瘿可出现肿物无压痛，随吞咽上下移动，但气瘿为甲状腺腺体弥漫性肿大，并非颈部出现肿块，且发病年龄与之不符（A错）。血瘿，表现为颈部血脉交结，多属于颈部血管瘤、颈部动脉体瘤，或肿大的甲状腺压迫深部静脉，引起浅表静脉扩张的合并症，临床少见，本病例肿块特点与之不符（C错）。石瘿，临床特点为结喉两侧结块，坚硬如石，高低不平，推之不移，本病例肿块特点与之不符（D错）。瘿痈，临床特点为结喉两侧结块，色红灼热，疼痛肿胀，甚而化脓，常伴有发热、头痛等症状。本病例肿块特点与之不符（E错）。